醛固酮的主要作用是
A. 保K⁺排Na⁺
B. 保Na⁺排K⁺
C. 保Na⁺保K⁺
D. 保Na⁺排H⁺
E. 保K⁺排H⁺

正确答案：B。保Na⁺排K⁺